下列有关胎盘屏障的叙述，错误的是
A. 是胎盘绒毛与子宫血窦间的屏障
B. 通透性与一般毛细血管相同
C. 几乎所有药物均可通过
D. 可阻止药物从母体进入胎儿的血液循环中
E. 妊娠妇女原则上应禁用一切影响胎儿发育的药物

正确答案：D。可阻止药物从母体进入胎儿的血液循环中

解析：胎盘屏障为胎盘绒毛与子宫血窦间的屏障（A对）；它能够将母体与胎儿的血液分开，几乎所有的药物均可通过（C对）；胎盘进入胎儿体内，仅是程度、快慢不同。胎盘屏障通透性与一般毛细血管相同（B对）；因此，屏障也能阻止水溶性或解离型药物进入胎儿体内，但脂溶性较高的药物仍能通过胎盘屏障（D错，为本题正确答案）；有些通过胎盘屏障的药物对胎儿有毒性甚至可以导致畸形，因此孕妇用药应特别谨慎，原则上应禁用一切影响胎儿发育的药物（E对）。